计量单位符号术语应在
A. 凡列
B. 附录
C. 索引
D. 正文
E. 品名目次

正确答案：A。凡列

解析：本题考查中国药典的构成。计量单位符号术语应在凡列（A对）。《中国药典》由凡例、正文、通则构成。1.凡例：凡例是正确使用《中国药典》进行药品质量检定的基本原则，是对《中国药典》正文、通则及与质量检定有关的共性问题的统一规定。主要包括：①名称与编排：其中附录（B错）（包括制剂通则、通用检测方法和指导原则）按分类编码。索引（C错）分别按中文索引、汉语拼音索引、拉丁名索引和拉丁学名索引顺序排列。②对照品、对照药材、对照提取物、标准品③精准度。2.正文（D错）：《中国药典》各品种项下收载的内容统称为标准正文，正文系根据药物自身的理化与生物学特性，按照批准的来源、处方、制法和贮藏、运输等条件所制定的、用以检测药品质量是否达到用药要求并衡量其质量是否稳定均一的技术规定。正文项下根据品种和剂型不同，按顺序可分别列有：品名（E错）、来源、处方、制法、性状、鉴别、检查、浸出物、特征图谱或指纹图谱、含量测定、炮制、性味与归经、功能与主治、用法与用量、注意、规格、贮藏、制剂、附注等。3.通则：通则主要收载制剂通则、通用检测方法和指导原则。制剂通则系按照药物剂型分类，针对剂型特点所规定的基本技术要求；通用检测方法系各正文品种进行相同检查项目的检测时所应采用的统一的设备、程序、方法及限度等；指导原则系为执行药典、考察药品质量、起草与复核药品标准等所制定的指导性规定。